干扰素诱导生成的寡核苷酸是
A. 2'-5'G
B. 3'-5'G
C. 2'-5'A
D. 3'-5'U
E. 2'-5'C

正确答案：C。2'-5'A